健康教育近期效果评价的含义为
A. 针对计划本身及实施过程中的管理问题
B. 针对了解计划实施后对人群健康状况改善的程度
C. 看实施后的整个结局
D. 着眼于计划实施后知识、态度、信念、价值观变化的程度
E. 其他方面

正确答案：D。着眼于计划实施后知识、态度、信念、价值观变化的程度